男性，70岁，无牙颌5年。初戴全口义齿时，当医生用双手示指分别放在上颌义齿两侧前磨牙区（牙合）面左右交替按压时，见义齿有左右翘动现象。在引起义齿不稳定的原因中，最先应该考虑的是
A. 印模变形
B. 模型不准
C. 基托边缘过长
D. 上颌结节过大
E. 腭隆突形成支点

正确答案：E。腭隆突形成支点

解析：腭隆突：20%左右患者硬腭中部的腭中缝处骨质隆起称腭隆突或上颌隆突，表面覆盖黏膜较薄，故此处又称硬区。为防止上颌义齿以此为支点而产生翘动和压痛，义齿基托组织面相应处需做缓冲处理。多数腭隆突较平坦，个别腭隆突过大甚至呈结节状，可能影响义齿基托的伸展，需在修复前进行外科手术切除。掌握“全口义齿戴入后问题及处理”知识点。